绿原酸分子结构中含有的结构单元是
A. 一分子大黄酸
B. 一分子胆酸
C. 一分子咖啡酸
D. 一分子甲酸
E. 一分子乙酸

正确答案：C。一分子咖啡酸

解析：本题考查的是绿原酸的结构。绿原酸分子结构中含有的结构单元是一分子咖啡酸（C对）。绿原酸的结构及其特点：绿原酸为一分子咖啡酸与一分子奎宁酸结合而成的酯，即3-咖啡酰奎宁酸；异绿原酸是绿原酸的同分异构体，为5-咖啡酰奎宁酸。3,4-、3,5-、4,5-二咖啡酰奎宁酸均为两分子咖啡酸与一分子奎宁酸结合而成的酯类化合物。